通过节肢动物叮咬吸血传播的疾病是
A. 流行性感冒
B. 霍乱
C. 炭疽
D. 流行性乙型脑炎
E. 乙肝

正确答案：D。流行性乙型脑炎

解析：本题考查传染病总论。流行性乙型脑炎（D对）、疟疾等疾病都是通过节肢动物叮咬吸血（媒介昆虫）进行传播的。